月经血呈不凝状态的原因是
A. 月经量多
B. 有宫颈粘液
C. 含有前列腺素
D. 含有大量纤溶酶
E. 含有脱落的阴道上皮细胞

正确答案：D。含有大量纤溶酶

解析：月经血中含有前列腺素及来自子宫内膜的大量纤维蛋白溶酶，后者可溶解纤维蛋白，使月经血不凝（D对），出血多时可有血凝块。